DIC患者出血与下列哪项因素关系最为密切？
A. 凝血因子Ⅻ被激活
B. 肝脏合成凝血因子障碍
C. 凝血因子大量消耗
D. 抗凝血酶物质增加
E. 血管通透性增加

正确答案：C。凝血因子大量消耗

解析：凝血因子大量消耗（C对ABDE错）与DIC患者出血关系最为密切，虽然肝脏和骨髓可代偿性产生增多，但若其消耗过多，代偿不足，则使血液中纤维蛋白原、凝血酶原、FV、FVIII、FX及血小板明显减少，使凝血过程发生障碍，导致出血。